女，19岁，农民。12月在水利工地上突起发热，伴头痛，眼眶痛，腰痛。病程第四日就诊时热已退，血压偏低，球结膜水肿，出血，胸背部见条索点状瘀点。前一日24小时尿量340ml，该病例最可能的诊断是
A. 败血症
B. 血小板减少性紫癜
C. 流行性出血热
D. 钩体病
E. 急性肾小球肾炎

正确答案：C。流行性出血热

解析：19岁青年女性患者，从事农业，在水利工地上发病（接触传染源几率大，可能接触传染源为老鼠），突然发病，伴头痛，眼眶痛，腰痛（出现‘三痛’，为全身中毒症状），球结膜水肿，出血，胸背部见条索点状瘀点（出现毛细血管损害征），第四日热退、血压低（进入低血压休克期），前一日24小时尿量340ml（＜400ml，为少尿，进入少尿期），根据患者的个人史、临床表现和实验室结果，最可能的诊断是流行性出血热（C对），临床上主要表现为“3H”症状，即高热（hyperpyrexia）、出血（hemorrhage）、低血压（hypotension），是一种多宿主性的自然疫源性传染病，其主要宿主动物和传染源均为啮齿动物，病原体为汉坦病毒。流行性出血热发热期临床表现总结口诀如下，“发热三红醉酒貌，头腰眼痛像感冒，腋下鞭击出血点，恶心呕吐蛋白尿”。败血症（A错）可表现为毒血症状如寒战、高热，全身不适等，出现皮疹，关节损害，肝脾肿大等（P225），病原体可为多种细菌和真菌。血小板减少性紫癜（B错）起病隐匿，可有出血倾向，多数较轻二局限，易反复发生，常有乏力，但不会出现头痛眼痛腰痛症状（八版内科学P624）。钩体病（D错）是钩端螺旋体病的简称，病原体为致病性钩端螺旋体，主要临床特征早期为钩端螺旋体败血症，中期为各脏器损害和功能障碍，后期为各种变态性反应后并发症，重症患者有明显的肝、肾、中枢神经系统损害和弥漫性肺出血（P253）。急性肾小球肾炎（E错）是以急性肾炎综合征为主要临床表现的一组疾病，临床特点是急性起病，出现血尿、蛋白尿。水肿和高血压，并可伴有一过性肾功能不全，多见于链球菌感染后，不会出现球结膜水肿，出血，胸背部条索点状瘀点（八版内科学P469）。